下列情形中，应按照《中华人民共和国药品管理法》规定的无证经营行为进行处罚的是
A. 经营范围为中药饮片、中成药制剂的丙药品批发企业购进销售生物制品
B. 甲药品生产企业销售本企业生产的化学药品
C. 乙药品生产企业未经药品上市许可持有人的委托，擅自生产持有人的药品
D. 丁诊所持有《医疗机构执业许可证》在诊疗范围内为患者开展诊疗服务并提供常用药品

正确答案：A。经营范围为中药饮片、中成药制剂的丙药品批发企业购进销售生物制品

解析：本题考查无证生产、经营药品的法律责任。下列情形中，应按照《中华人民共和国药品管理法》规定的无证经营行为进行处罚的是经营范围为中药饮片、中成药制剂的丙药品批发企业购进销售生物制品（A对）。无证生产、经营药品的法律责任：根据《药品管理法》第一百一十五条的规定，未取得药品生产许可证、药品经营许可证或者医疗机构制剂许可证生产、销售药品的（BD错），责令关闭，没收违法生产、销售的药品和违法所得，并处违法生产、销售的药品（包括已售出和未售出的药品，下同）货值金额十五倍以上三十倍以下的罚款；货值金额不足十万元的，按十万元计算。其他按照无证生产、经营处罚的情形，包括：①未经批准，擅自在城乡集市贸易市场设点销售药品或者在城乡集市贸易市场设点销售的药品超出批准经营的药品范围的。参见《药品管理法实施条例》第65条。②个人设置的门诊部、诊所等医疗机构向患者提供的药品超出规定的范围和品种的。参见《药品管理法实施条例》第67条。③药品生产企业、药品经营企业和医疗机构变更药品生产、经营许可事项，应当办理变更登记手续而未办理的，由原发证部门给予警告，责令限期补办变更登记手续；逾期不补办的，宣布其《药品生产许可证》《药品经营许可证》和《医疗机构制剂许可证》无效；仍从事药品生产经营活动的，依照《药品管理法》第一百一十五条的规定处罚。参见《药品管理法实施条例》第74条。